水肿首先出现于身体低垂部，可能是
A. 肾炎性水肿
B. 肾病性水肿
C. 心性水肿
D. 肝性水肿
E. 肺水肿

正确答案：C。心性水肿

解析：心性水肿（C对）由右心衰竭致体静脉回流障碍，首先表现为下垂部位的流体静脉压增高与水肿。肾性水肿（AB错）水肿部位首先出现于组织结构疏松，易容纳水肿液的眼睑或面部。肝性水肿（D错）由肝硬化时肝内广泛的结缔组织增生与收缩，以及再生肝细胞结节的压迫，肝静脉回流受阻，进而使肝静脉压和毛细血管流体静压增高而易伴发腹水。肺水肿（E错）为大量组织液积聚在肺泡、肺间质和细小支气管内。